治疗不孕瘀滞胞宫证，应首选
A. 逐瘀止血汤
B. 身痛逐瘀汤
C. 生化汤
D. 香棱丸
E. 少腹逐瘀汤

正确答案：E。少腹逐瘀汤

解析：逐瘀止血汤功能：行血祛瘀，活血止痛，主治外伤所致的血瘀气滞证（A错）。身痛逐瘀汤功能活血行气，祛瘀通络，痛痹止痛，主治瘀血痹阻经络证（B错）。生化汤功能养血祛瘀，温经止痛，主治血虚寒凝，瘀血阻滞证，产后恶露不行，小腹冷痛（C错）香棱丸功能行气活血，化瘀消癥，为癥瘕气滞血瘀证的选方（D错）。不孕症瘀滞胞宫证治宜逐瘀荡胞，调经助孕，方选少腹逐瘀汤（E对）。